控制心血管疾病的最有效的方法是
A. 临床治疗
B. 健康教育
C. 个体预防
D. 社区综合防治
E. 改善生活方式

正确答案：D。社区综合防治